身热不扬，胸闷不饥，头胀身重，小便不利，大便不爽，苔黄腻，脉濡数，属于
A. 上焦病证
B. 中焦病证
C. 下焦病证
D. 卫分病证
E. 营分病证

正确答案：B。中焦病证

解析：温邪内犯太阴，中焦湿热蕴郁，热蒸于湿，湿郁于肌腠，故身热不扬；湿性重浊，留于肌腠，故头胀身重；湿阻中焦，脾气受损，故见胸闷不饥，大便不爽；苔黄腻，脉濡数，均为湿热内蕴之象；故辨证为中焦太阴湿热证（B对）。上焦病证表现为发热，微恶风寒，微汗出，头痛，咳嗽，鼻塞，口渴，舌边尖红，脉浮数（A错）。下焦病证表现为身热，手足心热甚于手足背，颧红，口舌干燥，神倦，耳聋，舌红少苔，脉虚大（C错）。卫分病证常见于外感温热病初起，主要表现为发热，微恶风寒，头痛，口干微渴等（D错）。营分证是温热病发展过程中较为深重的阶段，主要表现为身热夜甚，心烦不寐，神昏谵语，斑疹隐隐等（E错）。